颌面部放线菌病用
A. 青霉素
B. 制霉菌素
C. 阿昔洛韦
D. 糖皮质激素
E. 异烟肼

正确答案：A。青霉素

解析：本题考查青霉素。颌面部放线菌病用青霉素（A对）。制霉菌素（B错）用于治疗念珠菌病、久治难愈的口腔黏膜病。阿昔洛韦（C错）为抗病毒药物，用于治疗疱疹性口炎等。糖皮质激素（D错）具有抗炎、抗过敏、免疫抑制作用。异烟肼（E错）为治疗结核病的首选药。